吗啡易引起
A. 快速耐受性
B. 成瘾性
C. 耐药性
D. 反跳现象
E. 高敏性

正确答案：B。成瘾性

解析：吗啡长期应用后会产生成瘾性（B对），停药后出现戒断综合征，甚至意识丧失，有的病人出现病态人格和明显强迫性觅药行为。长期反复应用吗啡后中枢神经系统对其敏感性降低，需增加剂量才能达到原来的药效即产生慢性耐受性，而不是快速耐受性（A错）。一般是抗菌药和抗肿瘤药物产生耐药性即抗药性而非吗啡等阿片类药物（C错）。反跳现象（D错）主要是指长期应用激素后，突然停药，症状出现突然加剧的现象。高敏性（E错）是指个体对药物的反应非常敏感，所需药量低于常用量，吗啡的效果与个体对药物的敏感性及疼痛程度有关，并不一定是高敏性。